个体从出现第二性征到性成熟的生理过程称为
A. 青春期
B. 青春早期
C. 青春中期
D. 青春后期
E. 青年期

正确答案：A。青春期